维生素B1严重缺乏发生心力衰竭的主要机制是
A. 心肌能量生成障碍
B. 心肌能量利用障碍
C. 心肌能量储存障碍
D. 心肌兴奋-收缩耦联障碍
E. 心肌收缩蛋白破坏

正确答案：A。心肌能量生成障碍

解析：维生素B1严重缺乏时，心肌细胞有氧氧化障碍，造成心肌能量生成障碍（A对），心肌收缩性降低，久之可发生心衰。